葡萄糖的主要转运方式是
A. 属于简单扩散
B. 属于被动转运
C. 属于主动转运
D. 属于滤过
E. 需要特殊的载体

正确答案：E。需要特殊的载体

解析：本题考查药物的转运方式。葡萄糖可经过主动转运和易化扩散吸收进入人体细胞中，两者都需要特殊的载体（E对）；简单扩散（A错）是顺浓度梯度的被动运输方式；被动转运（B错）是物质从高浓度区域向低浓度区域的转运；主动转运（C错）是药物借助载体或酶促系统，逆浓度梯度的转运；滤过（D错）是水溶性的小分子物质依靠膜两侧的流体静压或渗透压通过细胞膜上的膜孔的过程。